六个月婴儿，应该完成什么计划免疫
A. 卡介苗、乙肝疫苗、流脑疫苗
B. 脊髓灰质炎三价混合疫苗、百白破混合制剂、麻疹疫苗
C. 卡介苗、乙肝疫苗、脊髓灰质炎三价混合疫苗、百白破混合制剂
D. 脊髓灰质炎三价混合疫苗、百白破混合制剂、腮腺炎疫苗
E. 卡介苗、百白破混合制剂、麻疹疫苗

正确答案：C。卡介苗、乙肝疫苗、脊髓灰质炎三价混合疫苗、百白破混合制剂

解析：六个月婴儿，应该完成卡介苗（出生时）、乙肝疫苗（出生时第一次、1月龄第二次、6月龄第三次）、脊髓灰质炎三价混合疫苗（2月龄第一次、3月龄第二次、4月龄第三次）、百白破混合制剂（3月龄第一次、4月龄第二次、5月龄第三次）。A群流脑疫苗，需要在6～18月龄完成2次接种，中间间隔3个月，A+C群流脑疫苗第一次3周岁，第二次6周岁（A错），麻疹疫苗接种年龄为8月龄（）BE错，腮腺炎疫苗（麻腮风疫苗）需要在18～24月龄接种（D错）。